大面积急性心肌梗塞时可出现
A. 心肌各成份的不平衡生长
B. 心肌中大量收缩蛋白破坏
C. 心肌兴奋收缩耦联障碍
D. 心肌能量生成和/或利用障碍
E. 上述均可能存在

正确答案：B。心肌中大量收缩蛋白破坏

解析：大面积急性心肌梗塞时，心肌细胞缺血缺氧，发生变性坏死，大量收缩蛋白破坏（B对），心肌收缩性降低，导致心衰。